新药Ⅳ期临床试验的目的
A. 在健康志愿者中检验受试药的安全性
B. 在患者中检验受试药的不良反应发生情况
C. 在患者中进行受试药的初步药效学评价
D. 扩大试验，在300例患者中评价受试药的有效性、安全性、利益与风险
E. 受试新药上市后在社会人群中继续进行安全性和有效性评价

正确答案：E。受试新药上市后在社会人群中继续进行安全性和有效性评价

解析：本题考查临床药理学研究。新药Ⅳ期临床试验的目的是受试新药上市后在社会人群大范围内继续进行的安全性和有效性评价（E对）。新药Ⅳ期临床试验即批准上市后的监测，也称之为售后调研，是受试新药上市后在社会人群大范围内继续进行的安全性和有效性评价，在广泛、长期使用的条件下考察其疗效和不良反应，该期对最终确立新药的临床价值有重要意义。Ⅰ期临床试验：初步的临床药理学及人体安全性评价试验（A错）。观察人体对于新药的耐受程度和药代动力学，为制定给药方案提供依据。Ⅱ期临床试验：治疗作用初步评价阶段。其目的是初步评价药物对目标适应症患者的治疗作用和安全性（BC错），也包括为Ⅲ期临床试验研究设计和给药剂量方案的确定提供依据。Ⅲ期临床试验：治疗作用确证阶段。其目的是进一步验证药物对目标适应症患者的治疗作用和安全性，评价利益与风险关系（D错），最终为药物注册申请的审查提供充分的依据。